以下与对乙酰氨基酚相符的选项有
A. 具有解热镇痛作用
B. 具有抗炎作用
C. 可使颗粒性白细胞减少
D. 在空气中稳定
E. 在水中微溶，溶解于丙酮

正确答案：A、D、E。具有解热镇痛作用；在空气中稳定；在水中微溶，溶解于丙酮

解析：本题考查对乙酰氨基酚。对乙酰氨基酚为乙酰苯胺类解热镇痛药物（A对），无抗炎、抗风湿作用（B错）。本品在空气中稳定（D对），水溶液中的稳定性与溶液的pH有关。在pH6时最为稳定，半衰期为21.8年（25℃）。在热水或乙醇中易溶，在丙酮中溶解，在水中略溶（E对）。对乙酰氨基酚在使用剂量过大时，其代谢产物N-乙酰亚胺醌可引起肝毒性，无白细胞减少的不良反应（C错）。